根据五行相克关系确定的治法
A. 肝肾阴虚证临床表现为头晕目眩，采用滋水涵木法
B. 肝胃不和证临床表现为脘腹胀痛，采用抑木扶土法
C. 脾肾阳虚证临床表现为五更泄泻，采用益火补土法
D. 肺肾阴虚证临床表现为干咳少痰，采用金水相生法
E. 肺脾两虚证临床表现为痰多清稀，采用培土生金法

正确答案：B。肝胃不和证临床表现为脘腹胀痛，采用抑木扶土法

解析：本题考查的是五行在疾病治疗中的应用。根据五行相克关系确定的治法肝胃不和证临床表现为脘腹胀痛，采用抑木扶土法（B对）。五行在临床去顶治疗方法中的应用：1.根据相生规律确定的治法：主要有滋水涵木法（A错）、培土生金法（E错）、金水相生法（D错）、益火补土法（C错）等。2.根据相克关系确定的治法：主要有抑木扶土法、培土制水法、佐金平木法、泻南补北法等。